以下关于口腔单纯疱疹病毒传染方式错误的是
A. 呼吸道
B. 口腔
C. 鼻
D. 眼结膜
E. 消化道

正确答案：E。消化道

解析：本题考查口腔单纯疱疹病毒的传染方式。以下关于口腔单纯疱疹病毒传染方式错误的是消化道（E错，为本题的正确答案）。口腔单纯疱疹病毒传染方式主要为直接经呼吸道（A对）、口腔（B对）、鼻（C对）、眼结膜（D对）、生殖器黏膜或破损皮肤进入人体。